口腔医疗保健中最常见的病毒感染是
A. 乙肝
B. 结核
C. 单纯疱疹
D. AIDS
E. 梅毒

正确答案：A。乙肝

解析：病毒感染是口腔工作者工作最大的危险，在口腔医学的实践中，由于一些感染性疾病本身传染性强，或者危险性大，加之口腔疾病的普遍性和口腔临床工作的特殊性，给疾病的传播提供了便利条件，通过多种传播途径带来的各种感染问题已日趋明显。乙肝的发病率相对较高。掌握“口腔医疗保健中的感染”知识点。